卵巢上皮癌患者血清CA125，检测值最具有特异性意义的是
A. 粘液性癌
B. 浆液性腺癌
C. 内膜样癌
D. 未分化癌
E. 透明细胞癌

正确答案：B。浆液性腺癌

解析：卵巢上皮癌患者血清CA125，检测值最具有特异性意义的是浆液性腺癌（B对），一般阳性准确率可达80%以上。